椎管内手术时，常作为定位标志的是
A. 脑软脑膜
B. 终丝
C. 脑蛛网膜
D. 齿状韧带
E. 神经根

正确答案：D。齿状韧带

解析：齿状韧带（D对）由软脊膜在脊髓两侧，脊神经前、后根之间形成，固定脊髓于椎骨内，并减轻外界对脊髓的震荡伤害，还可作为椎管内手术的定位标志。